三早预防属于（）级预防
A. 零
B. 一
C. 二
D. 三

正确答案：C。二

解析：本题考查三级预防。三早预防是第二级（C对ABD错）预防的简称，指早发现、早诊断、早治疗。第一级预防又称病因预防，是从根本上消除或控制职业性有害因素对人的作用和损害；第二级预防是早期检测和诊断人体受到职业性有害因素所致的健康损害并予以早期治疗、干预；第三级预防是指在患病以后，给予积极治疗和促进康复的措施。